首过消除是
A. 弱酸性或弱碱性药物解离常数
B. 弱酸性或弱碱性药物解离常数的负对数
C. 口服药物吸收时首次通过肝脏经转化而使进入体循环的药量减少
D. 收入血的药量
E. 药物随胆汁排泄到达小肠后被重新吸收的过程

正确答案：C。口服药物吸收时首次通过肝脏经转化而使进入体循环的药量减少

解析：首过消除是指某些药物首次通过肠壁或肝脏时被其中的酶所代谢，使进人体循环药量减少的一种现象（C对）。